阿司匹林的药理作用为
A. 使血小板内TXA₂合成减少
B. 激活C0X-1活性
C. 促进PGs合成酶的活性
D. 促进血小板聚集
E. 促进凝血酶原形成

正确答案：A。使血小板内TXA₂合成减少